依据五行相克规律，下列描述正确的是
A. 悲胜恐
B. 悲胜喜
C. 恐胜喜
D. 怒胜喜
E. 恐胜思

正确答案：C。恐胜喜

解析：根据事物属性的五行归类，与木、火、土、金、水五行相对应的五脏为：肝、心、脾、肺、肾；与肝、心、脾、肺、肾五脏相对应的情志分别为：怒、喜、思、悲、恐。五脏按五行相克次序的排列为：木克土，土克水，水克火，火克金，金克木。故情志相胜关系为：悲胜怒（AB错），恐胜喜（C对E错），怒胜思（D错），喜胜悲，思胜恐。